男性患者59岁，上牙列缺失，右下8健康，近中舌侧倾斜，牙槽嵴丰满，上颌散在骨尖，颌间距离正常。病人进食时发生咬唇颊现象，原因是
A. 义齿边缘伸展不足
B. 垂直距离过高
C. 正中关系不正确
D. 人工牙排列覆盖过小
E. 以上都对

正确答案：D。人工牙排列覆盖过小

解析：本题考查病人进食时发生咬唇颊现象的原因。由于牙齿缺失时间过久，两颊内陷或舌体变大而造成咬颊咬舌现象，全口义齿戴用后一般可自行消失。当全口义齿不合适时病人进食时会发生咬唇颊现象，原因是人工牙排列覆盖过小（D对），应进行适当调磨。义齿边缘伸展不足（A错）导致的后果是固位不良。垂直距离过高（B错）导致的后果是下颌牙槽嵴普遍疼痛或压痛，面颊部酸痛、上腭部烧灼感等。正中关系不正确（C错），导致的后果是义齿不稳定、下颌偏斜，面部不对称等。